患者，女，43岁，1周前右上第一前磨牙开始咀嚼痛，伴有右侧眶下区肿痛3天。检查见右眶下肿胀明显、右上第一前磨牙深龋，髓腔暴露，叩诊（+++），前庭沟肿胀，压痛，有波动感。如此感染继续扩散，形成蜂窝组织炎，可并发
A. 脓毒血症
B. 败血症
C. 上颌窦炎
D. 下颌升支中央性骨髓炎
E. 海绵窦血栓性静脉炎

正确答案：E。海绵窦血栓性静脉炎

解析：本题考查间隙感染概述、眶下间隙、咬肌间隙感染。眶下间隙感染向上可向眶内直接扩散，形成眶内蜂窝组织炎，亦可沿面静脉、内眦静脉、眼静脉向颅内扩散，并发海绵窦血栓性静脉炎（E对）。